现场生物监测的特点是
A. 经济、简便、快速、结果可靠
B. 经济、准确、灵敏、结果正确
C. 简便、快速、灵敏、准确度高
D. 准确、灵敏、快速、结果可靠
E. 快速、灵敏、省事、准确度高

正确答案：A。经济、简便、快速、结果可靠

解析：本题考查现场生物监测的特点。现场生物监测主要通过对环境的植物、动物或微生物进行细胞遗传学或分子毒理学的直接监测。其特点是经济、简便、快速、结果可靠（A对BCDE错）。